男性，60岁。心前区阵发性疼痛1个月，多在夜间发作，与活动无关。每次发作15分钟，发作时心电图Ⅱ、Ⅲ、aVF导联ST段抬高。首选治疗的药物是
A. 硝酸酯类
B. β受体阻滞剂
C. 钙离子拮抗剂
D. 洋地黄类
E. 乙胺碘呋酮

正确答案：C。钙离子拮抗剂

解析：患者老年男性，阵发性胸痛，多于夜间发作，且与活动无关，心电图Ⅱ、Ⅲ、aVF导联ST段抬高，考虑诊断为变异型心绞痛。变异型心绞痛的特征为静息型心绞痛，表现为一过性ST段抬高，主要由冠脉痉挛引起。钙离子拮抗剂（C对）（P232）可扩张冠脉，解除冠脉痉挛，改善心内膜下心肌的供血，是变异型心绞痛的首选治疗药物。硝酸酯类（P232）（A错）可扩张正常或粥样硬化的冠状动脉，缓解心肌缺血，但一般不作为变异型心绞痛首选用药。β受体阻滞剂（B错）可阻滞能使冠状动脉扩张的β₂受体，使α受体相对兴奋，诱发冠状动脉痉挛而禁用于变异型心绞痛。洋地黄类（P172）（D错）为正性肌力药物，主要用于心力衰竭的强心治疗。乙胺碘呋酮（胺碘酮）（E错）为Ⅲ类抗心律失常药物，适用于各种室上性和室性快速性心律失常，对心绞痛的治疗意义不大。